马钱子胚乳切片，加1%钒酸铵硫酸溶液1滴，胚乳切面即显
A. 黄色
B. 蓝色
C. 蓝紫色
D. 橙红色
E. 黑绿色

正确答案：C。蓝紫色

解析：本题考查的是生物碱的显色反应。马钱子胚乳切片，加1%钒酸铵硫酸溶液1滴，胚乳切面即显蓝紫色（C对）。马钱子含士的宁，士的宁与1%钒酸铵硫酸溶液反应显蓝紫色。生物碱显色试剂及颜色特征：①Mandelin试剂（1%钒酸铵的浓硫酸溶液）：莨菪碱及阿托品显红色，吗啡显蓝紫色，可待因显蓝色，士的宁显蓝紫色，奎宁显淡橙色。②Macquis试剂（含少量甲醛的浓硫酸）：吗啡显橙色至紫色，可待因显洋红色至黄棕色。③Frohde试剂（1%钼酸钠或钼酸铵的浓硫酸溶液）：吗啡显紫色渐转棕色，小檗碱显棕绿色，利血平显黄色渐转蓝色，乌头碱显黄棕色。